提示胃溃疡患者发生癌变的典型表现是
A. 突发上腹痛并扩展至全腹剧痛，腹肌紧张，全腹压痛、反跳痛
B. 心率快、面色苍白、尿少、血压降低
C. 餐后上腹疼痛，呕吐大量酸臭残食，查体可见胃蠕动波
D. 上腹痛失去节律性，服用抑酸剂无效，粪隐血持续阳性
E. 反酸、烧心

正确答案：D。上腹痛失去节律性，服用抑酸剂无效，粪隐血持续阳性

解析：提示胃溃疡患者发生癌变的典型表现是上腹痛失去节律性，服用抑酸剂无效，粪隐血持续阳性（D对）。突发上腹痛并扩展至全腹剧痛，腹肌紧张，全腹压痛、反跳痛见于溃疡穿孔的弥漫性腹膜炎（A错）。心率快、面色苍白、尿少、血压降低见于溃疡出血引起的休克（B错）。餐后上腹疼痛，呕吐大量酸臭残食，查体可见胃蠕动波提示消化性溃疡并发幽门梗阻（C错）反酸、烧心见于GERD（E错）。